女性，60岁。诉患牙进食时易出血。检查发现：患牙有大而深的龋洞，洞内有红色肉芽组织，触痛（-），探诊出血。X线片示：髓腔底完整性已破坏。可诊断为
A. 牙髓息肉
B. 牙龈息肉
C. 牙周膜息肉
D. 慢性溃疡性牙髓炎
E. 牙周炎

正确答案：C。牙周膜息肉

解析：本题考查牙周膜息肉。女性，60岁。诉患牙进食时易出血。检查发现：患牙有大而深的龋洞，洞内有红色肉芽组织，触痛（-），探诊出血。X线片示：髓腔底完整性已破坏。可诊断为牙周膜息肉（C对）。患者患牙有大而深的龋洞，洞内有红色肉芽组织，触痛（-），探诊出血，据此可判断该红色肉芽组织为龋洞内的息肉。牙周膜息肉与牙髓息肉表现类似，临床上进行鉴别时，先通过X线片观察患牙根分叉区髓室底影像的连续性，还应仔细探查髓室底的完整性，由于患牙髓腔底的完整性已遭到了破坏，故患牙病变为牙周膜息肉。牙髓息肉（A错）的患牙髓室底是完整连续的。牙龈息肉（B错）多是在患牙邻（牙合）面出现龋洞时，由于食物长期嵌塞加之患牙龋损处粗糙边缘的刺激，牙龈乳头向龋洞所形成的空间增生，形成息肉样肉芽组织；当怀疑为牙龈息肉时，可自蒂部将息肉切除，如见出血部位位于患牙邻面龋洞龈阶外侧的龈乳头位置即可证实判断。慢性溃疡性牙髓炎（D错）多无自发痛，可查及深龋洞或其他近髓的牙体损害，患牙可见有大量软垢、牙石堆积，洞内食物残渣嵌入较多，但无肉芽组织。牙周炎（E错）患牙有牙周袋形成，多伴有牙齿松动，部分患牙可查及有龋洞或其他牙体组织缺损，洞内无红色肉芽组织。